属下肢浅静脉的是
A. 胫前静脉
B. 胫后静脉
C. 大隐静脉
D. 腘静脉
E. 股静脉

正确答案：C。大隐静脉

解析：大隐静脉（C对）和小隐静脉及其属支为下肢浅静脉。